问诊可作出明确诊断的是
A. 心绞痛
B. 风湿性关节炎
C. 颈静脉怒张
D. 甲状腺功能亢进
E. 焦虑

正确答案：A。心绞痛

解析：心绞痛可通过问诊来诊断（A对）。风湿性关节炎常累及膝、踝、肩和髋等四肢大关节，呈游走性疼痛，常在链球菌感染后出现，需通过辅助检查来明确诊断（B错）。颈静脉怒张是体征（C错）。甲状腺功能亢进需问诊、视诊、触诊结合来诊断（D错）。焦虑是症状（E错）。